关于肠系膜的叙述正确的是
A. 是将十二指肠、空肠、回肠系连固定于腹后壁的双层腹膜结构
B. 肠系膜根长约20cm
C. 其附着于腹后壁的部分称肠系膜根
D. 其肠缘长约2~4m
E. 无

正确答案：C。其附着于腹后壁的部分称肠系膜根

解析：肠系膜是将空肠和回肠系连固定于腹后壁的双层腹膜结构（A错），其附着于腹后壁的部分称为肠系膜根（C对），长约15cm（B错），肠系膜的肠缘系长达5~7m（D错）。